既可以做片剂的填充剂（稀释剂），也可以作为粉末直接压片黏合剂的是
A. 乙基纤维素
B. 醋酸纤维素
C. 羟丙基纤维素
D. 低取代羟丙基纤维素
E. 微晶纤维素

正确答案：E。微晶纤维素

解析：本题考查片剂的常用辅料。微晶纤维素（E对）主要在口服片剂和胶囊中用作填充剂和黏合剂，不仅可用于湿法制粒也可用于干法直接压片。还有一定的润滑和崩解作用，在片剂制备中非常有用。乙基纤维素（A错）为黏合剂。醋酸纤维素（B错）为水不溶型薄膜衣材料。羟丙基纤维素（C错）为黏合剂。低取代羟丙基纤维素（D错）为崩解剂。